下列哪项属于急性酒精中毒
A. 单纯醉酒
B. 依赖综合征
C. 酒中毒幻觉症
D. 酒中毒妄想症
E. 酒中毒性脑病

正确答案：A。单纯醉酒